以下哪些疾病与遗传因素无关
A. 先天无牙
B. 牙周病
C. 龋齿
D. 错（牙合）畸形
E. 乳光牙本质

正确答案：C。龋齿

解析：本题考查与遗传因素有关的疾病。龋齿的四联因素学说包括细菌、食物、宿主和时间，与遗传关系不大（C错，为本题的正确答案）。先天无牙也叫外胚叶发育不全综合征，是一种遗传性疾病（A对），多数病例为伴X隐形遗传，也可为常染色体显性或隐性遗传。遗传因素是牙周病的一个全身促进因素（B对）。错（牙合）畸形是遗传和环境两大因素导致的疾病（D对）。乳光牙本质是Ⅱ型牙本质发育不全，属于常染色体显性遗传性疾病（E对）。